由于水和电解质平衡紊乱可致何种类型中暑
A. 热射病（包括日射病）
B. 热痉挛
C. 热衰竭
D. 中暑
E. 休克

正确答案：B。热痉挛

解析：本题考查热痉挛的症状。热痉挛（B对ACDE错）是由于大量出汗，体内钠、钾过量丢失所致。由于水和电解质平衡紊乱导致明显的肌肉痉挛，伴有收缩痛。痉挛以四肢肌肉及腹肌等经常活动的肌肉为多见，尤以腓肠肌为最。痉挛常呈对称性，时而发作，时而缓解。病人神志清醒，体温多正常。